红细胞大量破坏引起DIC的机制是
A. 因为红细胞含有磷脂和ADP,具有直接促凝和激活血小板的作用
B. 红细胞可释放大量的组织因子
C. 不是通过激活血小板起作用的
D. 使抗凝物质生成减少
E. 使纤溶物质生成减少

正确答案：A。因为红细胞含有磷脂和ADP,具有直接促凝和激活血小板的作用

解析：因为红细胞含有磷脂和ADP,具有直接促凝和激活血小板的作用（A对BCDE错），所以红细胞大量破坏引起DIC，一方面，破坏的红细胞释放大量 ADP等促凝物质，促进血小板黏附、聚集，导致凝血；另一方面，红细胞膜磷脂可浓缩并局限FVII、FIX、FX及凝血酶原等，生成大量凝血酶，促进DIC的发生。